慢性苯中毒对造血系统的早期影响是
A. 白细胞减少，以中性粒细胞减少为主
B. 白细胞减少，以淋巴细胞减少为主
C. 白细胞减少，但淋巴细胞增加
D. 血小板减少，有出血倾向
E. 全血细胞减少

正确答案：A。白细胞减少，以中性粒细胞减少为主

解析：本题考查慢性苯中毒对造血系统的早期影响。慢性苯中毒主要损害造血系统。最早和最常见的血象异常表现是持续性白细胞计数减少，主要是中性粒细胞减少（A对BCDE错），白细胞分类中淋巴细胞相对值可增加到40%左右。电镜检查可见血小板形态异常。严重中毒者骨髓造血系统明显受损，甚至出现再生障碍性贫血、骨髓增生异常综合征（MDS）,少数可转化为白血病。